种植覆盖全口义齿的固位方式不包括
A. 冠外附着体
B. 球帽
C. 磁性附着体
D. 杆卡
E. 套筒冠

正确答案：A。冠外附着体

解析：本题考查种植覆盖全口义齿的固位方式。种植覆盖全口义齿的固位方式不包括冠外附着体（A错，为本题正确答案）。冠外附着体为可摘局部义齿固位形式。1.种植覆盖全口义齿的固位方式有球帽状附着体（B对）、磁性固位附着体（C对）、杆卡式附着体（D对）、套筒冠附着体（E对）。2.可摘局部义齿按固位形式不同，可分为冠内固位体以及冠外固位体如卡环型固位体、套筒冠固位体、冠外附着体等。